面横裂是由于
A. 一侧上颌突未能与内侧鼻突融合
B. 上颌突与外侧鼻突未融合
C. 上颌突与下颌突未融合
D. 原发腭突未能在一侧与继发腭突融合
E. 原发腭突未能在两侧与继发腭突融合

正确答案：C。上颌突与下颌突未融合

解析：本题考查面部发育异常-面横裂。面横裂是由于上颌突与下颌突未融合（C对）。口腔颌面部的发育始于胚胎发育的第3周，第一对鳃弓分叉发育形成上下颌突；第5周时，额鼻突的下缘两侧各出现一个嗅窝，嗅窝的内外侧分别为内侧鼻突和外侧鼻突；第8周时，左右上颌突的内面生出一对板状突起称为继发腭突，两侧的继发腭突在中线融合形成腭的大部。上颌突与下颌突未融合发生面横裂。一侧上颌突未能与内侧鼻突融合（A错）则在上唇一侧产生唇裂。上颌突与外侧鼻突未融合（B错）则形成面斜裂。腭裂的形成与唇裂相似，同样为胚突融合不全或完全不融合所致，原发腭突未能在一侧与继发腭突融合（D错），则形成单侧腭裂。原发腭突未能在两侧与继发腭突融合（E错），则形成双侧腭裂。